关于制剂质量要求和使用特点的说法，正确的是
A. 注射剂应进行微生物限度检查
B. 眼用液体制剂不允许添加抑菌剂
C. 生物制品一般不宜制成注射用浓溶液
D. 若需同时使用眼膏剂和滴眼剂，应先使用眼膏剂
E. 冲洗剂开启使用后，可小心存放，供下次使用

正确答案：C。生物制品一般不宜制成注射用浓溶液

解析：本题考查制剂质量要求和使用特点。注射用浓溶液系指原料药物与适宜辅料制成的供临用前稀释后静脉滴注用的无菌浓溶液。生物制品一般不宜制成注射用浓溶液（C对）。注射剂是指原料药物与适宜的辅料制成的供注入体内的无菌制剂。应进行无菌检查而非微生物限度检查（A错）。多剂量眼用制剂一般应加适当的抑菌剂（B错），尽量选用安全风险小的抑菌剂，产品标签应标明抑菌剂的种类和标示量。除另有规定外，在制剂确定处方时，该处方的抑菌效力应符合抑菌效力检查法（通则1121）的规定。尽量单独使用一种滴眼剂，若有需要需间隔10分钟以上再使用两种不同的滴眼剂。若同时使用眼膏剂和滴眼剂需先使用滴眼剂（D错）。冲洗剂系指用于冲洗开放性伤口或体腔的无菌溶液剂。冲洗剂应无菌、无毒、无局部刺激性；开启后应立即使用，未用完的应弃去（E错）。